枳壳的主产地是
A. 广东
B. 江西
C. 湖南
D. 河南
E. 广西

正确答案：B。江西

解析：本题考查的是枳壳的产地。枳壳的主产地是江西（B对）。枳壳：【产地】主产于江西、四川、湖北、贵州等省。多系栽培。以江西清江、新干所产最为闻名，商品习称“江枳壳”，量大质优。主产地为广东（A错）的药材有粉葛、巴戟天、土茯苓、沉香、枇杷叶、草豆蔻、阳春砂、广金钱草、广藿香、金钱白花蛇等。主产地为湖南（C错）的药材有商陆、玉竹、栀子、朱砂、雄黄、炉甘石。主产地为河南（D错）的药材被称为怀药。怀药：主产地河南。如著名的“四大怀药”——地黄、牛膝、山药、菊花；以及天花粉、瓜蒌、白芷、辛夷、红花、金银花、山茱萸等主产地为广西（E错）的药材有山豆根、苏木、石斛、肉桂、蛤蚧等。